关于两条生存曲线的表述正确的是
A. 生存曲线都是严格下降的
B. 生存曲线的纵坐标为生存概率
C. 生存曲线平缓的，表示预后较好
D. 如果采用寿命表法，则生存曲线呈阶梯型
E. 生存曲线横坐标中点为中位生存期

正确答案：C。生存曲线平缓的，表示预后较好